成纤维细胞损伤后转变成骨细胞
A. 伪膜
B. 化生
C. 渗出
D. 转化
E. 增生

正确答案：B。化生

解析：成纤维细胞损伤后转变成骨细胞是骨化生（B对）的过程。伪膜（A错）又叫假膜（P75），是指黏膜发生纤维素性炎时，渗出的纤维素、中性粒细胞和坏死黏膜组织以及病原菌等在黏膜表面形成的灰白色膜状物。渗出（P64）（C错）是指炎症局部组织血管内的液体、蛋白质和各种炎细胞通过血管壁进入组织间隙、体腔、体表和黏膜表面的过程。转化（D错）是指某一基因型的细胞从周围介质中吸收来自另一基因型细胞的DNA而使它的基因型和表现型发生相应变化的现象。增生（P8）（E错）是指细胞有丝分裂活跃导致组织或器官内细胞数目增多的现象。